HDL2是
A. 运送内源性TG
B. 运送内源性Ch
C. 运送外源性TG
D. 蛋白质含量最高
E. 与冠状动脉粥样硬化的发生率呈负相关

正确答案：E。与冠状动脉粥样硬化的发生率呈负相关

解析：HDL2指的是高密度脂蛋白2，与冠状动脉粥样硬化的发生率呈负相关。掌握“甘油磷脂、胆固醇和血脂蛋白代谢”知识点。